医务人员在手术中应遵循的伦理要求是
A. 平等相待，廉洁奉公
B. 积极进取，保证安全
C. 精诚团结，密切协作
D. 耐心倾听，正确引导
E. 关心体贴，减少痛苦

正确答案：C。精诚团结，密切协作

解析：手术中的伦理要求：1.严密观察，处理得当；2.认真操作，一丝不苟；3.互相支持，团结协作（C对）。耐心倾听，正确引导（P111）（D错）为诊治的基本伦理要求。